对人而言，HLA分子属于
A. 异种抗原
B. 同种异型抗原
C. 改变的自身抗原
D. 隐蔽抗原
E. 肿瘤相关抗原

正确答案：B。同种异型抗原